具有清热利尿、凉血解毒功效的药物是
A. 石膏
B. 知母
C. 生地
D. 玄参
E. 栀子

正确答案：E。栀子

解析：本题考查的是栀子的功效。具有清热利尿、凉血解毒功效的药物是栀子（E对）。栀子：【功效】泻火除烦，清热利尿，凉血解毒，消肿止痛。石膏（A错）：【功效】生用：清热泻火，除烦止渴；煅用：收湿敛疮，生肌止血。知母（B错）：【功效】清热泻火，滋阴润燥。生地（C错）即生地黄。生地黄：【功效】清热凉血，养阴生津，润肠。玄参（D错）：【功效】清热凉血，滋阴降火，解毒散结，润肠。